槟榔的主治病证有
A. 绦虫病
B. 蛔虫病
C. 脚气浮肿
D. 泻痢里急后重
E. 姜片虫病

正确答案：A、B、C、D、E。绦虫病；蛔虫病；脚气浮肿；泻痢里急后重；姜片虫病

解析：本题考查的是槟榔的主治病证。槟榔的主治病证有绦虫病（A对）、蛔虫病（B对）、脚气浮肿（C对）、泻痢里急后重（D对）与姜片虫病（E对）。槟榔：【主治病证】（1）绦虫病，姜片虫病，蛔虫病，蛲虫病，钩虫病等。（2）食积气滞之腹胀、便秘，泻痢里急后重。（3）水肿，脚气浮肿。（4）疟疾。